某筛选试验用被病例诊断为乳癌患者和非乳癌患者各400名妇女，试验结果乳癌组阳性者100人，非乳癌组阳性者50人，问该试验的灵敏度为
A. 0.875
B. 0.676
C. 0.25
D. 0.333
E. 0.1255

正确答案：C。0.25

解析：本题考查灵敏度的计算。根据题中数据代入公式得出灵敏度＝TP/（TP＋FN）＝100/400×100%＝25%（C对ABDE错）。